以下关于手-足-口病的诊断错误的是
A. 夏秋季多见于托幼单位群体发病
B. 多为3岁以下幼儿
C. 手、足、口部位的突然发疹起疱，皮肤的水疱不破溃
D. 以冬春两季多见，以发热及成批出现周身性、向心性分布的红色斑丘疹、疱疹、痂疹为特征
E. 一般全身症状轻，可自愈

正确答案：D。以冬春两季多见，以发热及成批出现周身性、向心性分布的红色斑丘疹、疱疹、痂疹为特征

解析：手-足-口病的诊断：托幼单位是本病的主要流行场所，婴幼儿和儿童普遍易感，以5岁以下儿童为主。手-足-口病的流行无明显的地区性。一年四季均可发病，但夏秋季最易流行。该病表现为手、足、口部位的突然发疹起疱，皮肤的水疱不破溃；一般全身症状轻，可自愈。而D项内容属于水痘的临床表现，多为水痘-带状疱疹病毒感染引起。掌握“手-足-口病”知识点。